大面积烧伤病人，口渴、尿少，尿比重1.030，脉搏140次/分，神志淡漠，肢体冷，首要的处理应是
A. 清创
B. 给予吗啡止痛
C. 给予强心剂
D. 创面涂抗菌药物
E. 静脉快速补液

正确答案：E。静脉快速补液

解析：此患者临床表现可以判断由于烧伤导致休克。则首要处理需要大量静脉快速补液。掌握“火器伤、热烧伤”知识点。